下列哪种涎腺疾病以中年女性多见
A. 急性化脓性腮腺炎
B. 慢性复发性腮腺炎
C. 慢性阻塞性腮腺炎
D. 下颌下腺炎
E. 舍格伦综合征

正确答案：E。舍格伦综合征

解析：本题考查以中年女性多见的涎腺疾病。舍格伦综合征（E对）多见于中年以上女性，与更年期存在一定关系。急性化脓性腮腺炎（A错）大多是慢性腮腺炎基础上的急性发作或系邻近组织急性炎症的扩散，没有明显的年龄倾向。临床上慢性复发性腮腺炎（B错）比较常见，儿童和成人均可发生。慢性阻塞性腮腺炎（C错）在临床上男性发病多于女性。下颌下腺炎（D错）多见于20～40岁的中青年。